咳声如犬吠样，可见于
A. 百日咳
B. 白喉
C. 感冒
D. 肺痨
E. 肺痿

正确答案：B。白喉

解析：咳声如犬吠是肺肾阴虚，疫毒攻喉所致，多见于白喉（B对）。咳声短促，呈阵发性、痉挛性，连续不断，咳后有鸡鸣样回声，并反复发作者，称为顿咳【百日咳】（A错）。感冒的咳嗽特点多为一声声刺激性咳嗽，好似咽喉瘙痒，无痰（C错）。肺痨一般有干咳或只有少量粘液，伴有轻微咯血（D错）。肺痿的咳嗽特点以咳吐浊唾涎沫为特征（E错）。